在居民小区建设健康步道，改善小区中绿化环境，以鼓励他们参加体育锻炼，这种方法属于
A. 健康促进
B. 卫生宣传
C. 社区启蒙
D. 健康教育
E. 临床预防服务

正确答案：A。健康促进

解析：健康促进（A对）是在健康教育（D错）的基础上进一步发展，旨在帮助受众建立健康行为的重要的战略和方法。其中，加强社区行动是一种行之有效的社会健康促进方法，如题所述即为健康促进的一种方法。卫生宣传（B错）、社区启蒙（C错）均为健康教育的一种。